患者已经行胆囊切除术，1天前因腹痛行十二指肠ERCP手术，现突发剧烈疼痛，左中上腹明显，向背部放射，考虑什么疾病
A. 急性胰腺炎
B. 消化性溃疡穿孔
C. 急性心肌梗塞
D. 急性胆管炎
E. 胆总管结石

正确答案：A。急性胰腺炎

解析：患者行胆囊切除术，1天前因腹痛行十二指肠ERCP手术（急性胰腺炎的病因），出现突发剧烈疼痛，左中上腹明显，向背部放射，结合患者的病因和表现，考虑为急性胰腺炎（A对）。以上四种疾病都未出现左中上腹部的剧烈疼痛，向背部放射的表现，故可除外。